有关外侧丘系纤维的描述，下列哪项正确
A. 在脑桥部完全交叉至对侧
B. 终于上丘
C. 终于下丘
D. 发自下橄榄核
E. 传导头面部本体感觉冲动

正确答案：C。终于下丘

解析：外侧丘系纤维参与听觉传导通路（E错）。其发自上橄榄核外侧（D错），在脑桥内形成斜方体并交叉至对侧（A错），经中脑被盖的背外侧部大多数止于下丘核（B错C对）。